吴茱萸的功效有
A. 散寒止痛
B. 温肺化饮
C. 疏肝下气
D. 燥湿止泻
E. 祛风止痒

正确答案：A、C、D。散寒止痛；疏肝下气；燥湿止泻

解析：本题考查的是吴茱萸的功效。吴茱萸的功效有散寒止痛（A对）、疏肝下气（C对）与燥湿止泻（D对）。吴茱萸：【功效】散寒止痛，疏肝下气，燥湿止泻。干姜：【功效】温中，回阳，温肺化饮（B错）。地肤子：【功效】利尿通淋，祛风止痒（E错）。